41岁男性，腰痛伴右下肢放射痛3月，反复发作，与劳累有关，咳嗽或用力排便时可加重疼痛。查体右直腿抬高试验40°阳性，加强试验阳性。X线片示：L4～5椎间隙变窄。该患者右下肢麻木的区域可能为
A. 小腿外侧或足背
B. 大腿前侧
C. 小腿前内侧
D. 小腿及足外侧足底
E. 臀部及大腿后侧

正确答案：A。小腿外侧或足背

解析：男性患者，腰痛伴右下肢放射痛（腰椎间盘突出症典型表现），与劳累有关，咳嗽或用力排便时可加重疼痛（坐骨神经痛典型表现），查体右直腿抬高试验40°阳性，加强试验阳性（腰椎间盘突出症重要体征），X线片示L4-5椎间隙变窄（提示有腰椎间盘退行性变），结合患者症状、体征和影像学检查，该患者应诊断为腰L4-5椎间盘突出症。根据受累神经不同，病人常出现相应的感觉、肌力及反射异常。腰4-5椎间盘突出主要压迫L5，表现为小腿外侧和足背痛触觉减退，拇趾背伸肌力减弱（A对）。腰1-2之间对应L2受累，表现为大腿前中部感觉减退，髂腰肌肌力减弱（B错）。腰2-3之间对应L3受累，表现为股骨内髁感觉减退，股四头肌肌力减弱，膝反射减弱或消失。腰3-4之间对应L4受累，表现为内踝感觉减退，足背伸肌肌力减弱。小腿前内侧区域感觉异常为股神经损伤表现（C错）。腰5-骶1之间对应S1受累，表现为外踝附近及足外侧痛、触觉感觉减退，足跖屈障碍，踝反射减弱或消失（D错）。臀部及大腿后侧感觉麻木可见于坐骨神经或臀上皮神经损伤（E错）。